男，4岁。因反复低热、咳嗽和盗汗15天就诊。查体：T37.5℃，右眼球结膜充血，内眦部有一疱疹，咽部充血，右颈部可触及黄豆大小淋巴結，无明显压痛，心肺无异常，肝肋下1.5厘米，血WBC5.6×10⁹/L，L0.70。宜采取的治疗措施是
A. 应用大环内酯类抗生素
B. 糖皮质激素治疗
C. 抗结核治疗
D. 抗病毒治疗
E. 支气管镜取异物

正确答案：C。抗结核治疗

解析：4岁患儿，有低热、盗汗、眼球结膜充血、颈部淋巴结肿大的特征性表现，应诊断为原发性肺结核。原发性肺结核的治疗措施是抗结核治疗（C对），目前主张长期、规律、联合化疗，可有效治疗原发性肺结核。支气管镜取异物对支气管有结核病灶的肺结核有确诊的价值，由此可见，该措施是用来确诊的，并不是治疗措施（E错）。应用大环内酯类抗生素（A错）、糖皮质激素治疗（B错）、抗病毒治疗（D错）都是针对一般感染的治疗方式，结核是很严重的传染病，化疗对结核敏感，其他治疗方法的作用很小。